细胞水肿的发生机制主要与下列哪种细胞器的功能障碍有关
A. 高尔基体
B. 内质网
C. 溶酶体
D. 线粒体
E. 核糖体

正确答案：D。线粒体

解析：细胞水肿的发生机制主要与线粒体（D对）的功能障碍有关。当线粒体受损时，ATP生成减少，细胞膜Na⁺-K⁺泵功能障碍，导致细胞内Na⁺积聚，吸引大量水分子进入细胞，引起细胞水肿。